下列有关尖牙卡环的描述，不正确的是
A. 用于尖牙
B. 丝材的弹性好，固位力较强
C. 向下向前进入唇面近中倒凹
D. 由近中切支托顺舌面近中边缘嵴向下
E. 经舌隆突、舌面远中边缘嵴向上至远中切角

正确答案：B。丝材的弹性好，固位力较强

解析：尖牙卡环：用于尖牙，尤其是下颌尖牙。卡环由近中切支托顺舌面近中边缘嵴向下，经舌隆突、舌面远中边缘嵴向上至远中切角，向下向前进入唇面近中倒凹。小连接体在远中邻面与卡环臂相连。掌握“局部义齿固位体”知识点。